“吐下之余，定无完气”的理论基础是
A. 气能生津
B. 气能行津
C. 气能摄津
D. 津能载气
E. 津血同源

正确答案：D。津能载气

解析：“吐下之余，定无完气”的含义为：随着呕吐、泄泻，大量津液流失，气也会随之损耗。其机理为：津液是气运行的载体之一（即津能载气）-在血脉之外，气的运行必须依附于津液，否则会使气漂浮失散而无所归，故随着呕吐、泄泻，大量津液流失，气也会随之漂浮失散（D对）。气能生津是指气可以促进和激发津液的生成（A错）。气能摄津是指气控制津液及其代谢产物的排泄，以防止体内津液无故流失（C错）。气能行津是指气能推动和调控津液的正常输布运行（B错）。